治疗肺炎气阴两伤，余热未尽证，应首选
A. 竹叶石膏汤
B. 犀角地黄汤
C. 清营汤
D. 参苏饮
E. 二陈汤

正确答案：A。竹叶石膏汤

解析：肺炎气阴两伤，余热未尽为正虚邪恋证，治宜益气养阴，润肺化痰，首选竹叶石膏汤（A对）。犀角地黄汤（B错），用于热入血分证。清营汤（C错），用于热闭心包证。参苏饮（D错），用于外感风寒，内有痰饮证。二陈汤（E错），用于慢性支气管炎痰浊阻肺证。